既善杀虫消积，又能行气利水的药是
A. 槟榔
B. 香加皮
C. 苦楝皮
D. 使君子
E. 南瓜子

正确答案：A。槟榔

解析：本题考查的是槟榔的功效。既善杀虫消积，又能行气利水的药是槟榔（A对）。槟榔：【功效】杀虫，消积，行气，利水，截疟。香加皮（B错）：【功效】祛风湿，强筋骨，利水消肿。苦楝皮（C错）：【功效】杀虫，疗癣。使君子（D错）：【功效】杀虫消积。南瓜子（E错）：【功效】杀虫。